下列哪种为我国规定报告的甲类传染病
A. 麻疹
B. 鼠疫
C. 流感
D. 新生儿破伤风
E. 血吸虫

正确答案：B。鼠疫